HbA的α亚基与O₂结合后产生变构效应，从而
A. 促进α亚基与O₂结合，抑制β亚基与O₂结合
B. 抑制α亚基与O₂结合，促进β亚基与O₂结合
C. 促进其他亚基与O₂结合
D. 促进α亚基与O₂结合，同时促进β亚基与CO₂结合
E. 抑制其他亚基与O₂结合

正确答案：C。促进其他亚基与O₂结合